在希波克拉底誓言中，“凡息结石者，我不施手术，此则有待于专家为之”可以理解为是
A. 执业药师提供药学服务的限制性条件
B. 外科医生手术的限制性条件
C. 药品批发商行为的限制性条件
D. 药品生产商行为的限制性条件
E. 所有人员行为的限制性条件

正确答案：A。执业药师提供药学服务的限制性条件